医生在诊疗过程中经常对患者使用医学专业术语，使患者难以理解，容易造成误解。这种医患交流的问题属于
A. 回忆不良
B. 沟通障碍
C. 信息缺乏
D. 同情不够
E. 依从性差

正确答案：B。沟通障碍

解析：医患之间沟通障碍（B对）主要体现在医生在诊疗过程中听得过少和说得过少两方面：听得过少，即未能认真仔细地倾听病人对病情的陈述，有的甚至连头都不抬，还未等病人讲完，各种检查单子已经开好；说得较少，即不愿意回答病人提出的问题，对其咨询要么是态度冷漠、只言片语，解释回答不到位，要么就是用刻板的医学术语进行解释，使人产生距离感和疏远感，让本就脆弱的病人心理雪上加霜，导致医患关系的不和谐。回忆不良（A错）、依从性差（E错）（P71）为病人未履行自身如实提供病情和有关信息、遵守医院规章制度，尊重医务人员及其劳动的义务，属于医德基本范畴。医德情感包括同情感（D错）、责任感和事业感，亦属于医德基本范畴。